普查中对400例有乳腺癌史的妇女和400名正常妇女进行活检诊断，结果是前者中100例阳性，后者50例阳性。该试验的灵敏度为
A. 0.87
B. 0.67
C. 0.25
D. 0.33
E. 0.12

正确答案：C。0.25

解析：本题考查灵敏度的计算。根据题中数据代入公式得出灵敏度＝TP/（TP＋FN）＝100/400×100%＝25%（C对ABDE错）。